多肽链中肽键的本质是
A. 磷酸二酯键
B. 二硫键
C. 糖苷键
D. 酰胺键
E. 疏水键

正确答案：D。酰胺键

解析：蛋白质中的氨基酸借肽键相互连接生成多肽链，肽键即-CO-NH-指一分子氨基酸的α-羧基和1分子氨基酸的α-氨基脱去一分子水缩合行成的酰胺键，例如1分子甘氨酸的α-羧基和1分子甘氨酸的α-氨基脱去一分子水缩合成为甘氨酰甘氨酸，在甘氨酰甘氨酸分子中连接两个氨基酸的酰胺键称为肽键，因此肽键的本质是酰胺键，D选项正确。DNA、RNA通过3’-5’磷酸二酯键连接形成大分子，蛋白质的一级结构包含的化学键有肽键和二硫键，蛋白质三级结构的形成和稳定主要靠次级键如疏水键、盐键、氢键、范德华力等，糖苷键指连接糖苷分子中的非糖部分与糖基的特定类型的化学键，见于糖原合成过程中糖链的延长。